生长发育长期变化（趋势）的主要表现是
A. 营养的全面改善
B. 身高一代比一代高，性发育的提前
C. 都市化进程的加快
D. 人群大规模迁移
E. 体育活动的广泛开展

正确答案：B。身高一代比一代高，性发育的提前

解析：本题考查生长发育的长期趋势。自19世纪后期，许多国家出现了生长发育的长期变化，其主要表现是身材一代比一代高大，性成熟明显提前（B对ACDE错）。